可给病员自用的药物是
A. 2％碘甘油
B. 碘酚
C. 10％过氧化氢溶液
D. 缓释抗菌药物
E. 以上均可

正确答案：A。2％碘甘油

解析：本题考查牙周病的局部药物治疗-涂布消炎收敛药物。牙周局部用药的方法有含漱、涂布、局部冲洗以及牙周袋内缓释或控释药物的使用等。2％碘甘油患者可自行涂布，起到消炎收敛的作用（A对）。碘酚为腐蚀性较强的药物，患者不宜自行用药（B错）。10％过氧化氢溶液应医师给予冲洗，不能患者自行用药（C错）。缓释抗菌药物应置于牙周袋内，患者不易自行放入牙周袋内（D错）。